关于注射剂特点的说法错误的是
A. 给药后起效迅速
B. 给药剂量易于控制
C. 适用于不宜口服用药的患者
D. 给药方便，特别适用于幼儿患者
E. 安全性不及口服制剂

正确答案：D。给药方便，特别适用于幼儿患者

解析：本题考查注射剂特点。由于注射剂注射时易引起疼痛，给药不方便，不适用于幼儿患者（D错，为本题正确答案）。注射剂的特点（1）药效迅速（A对）、剂量准确（B对）、作用可靠。（2）可适用于不宜口服给药的患者（C对）和不宜口服的药物。（3）可发挥局部定位作用。但注射给药不方便，注射时易引起疼痛。(4)易发生交叉污染，安全性不及口服制剂（E对）。(5)制造过程复杂，对生产的环境及设备要求高，生产费用较大，价格较高。